胎产式是指
A. 胎儿在子宫内的姿势
B. 胎儿位置与母体骨盆的关系
C. 胎体纵轴与母体纵轴的关系
D. 胎儿先露部的指示点与母体骨盆的关系
E. 最先进入骨盆入口的胎儿部分

正确答案：C。胎体纵轴与母体纵轴的关系